噪声频率大于800Hz者称为
A. 连续性噪声
B. 脉冲性噪声
C. 稳态噪声
D. 非稳态噪声
E. 高频噪声

正确答案：E。高频噪声